女，25岁。发现心悸、盗汗、易怒1年，伴有饮食量增加及消瘦。查体：BP110/80mmHg，重度突眼，甲状腺弥漫性肿大，深入胸骨后上纵隔内，心率116次/分。测血T₃、T₄值高于参考值上限一倍。该患者术前最适合的药物准备是
A. 丙硫氧嘧啶
B. 碘剂
C. 抗甲状腺药+碘剂
D. 抗甲状腺药+普萘洛尔
E. 普萘洛尔

正确答案：C。抗甲状腺药+碘剂

解析：丙硫氧嘧啶（A错）为抗甲状腺药物，可抑制甲状腺素的合成，控制甲亢症状，但单独应用可使甲状腺肿大并充血，增加手术的困难及风险。临床上常用的估算基础代谢率公式为[（脉压+脉率）-111]×100%，带入患者体查结果可知，该患者基础代谢率为+35%，属中度甲亢。碘剂（B错）能抑制甲状腺素的释放并使甲状腺缩小变硬，适用于轻症患者。抗甲状腺药+碘剂（C对）能有效控制甲亢症状，降低基础代谢率，有利于手术顺利进行并能有效预防术后并发症，为最合适的药物准备方案。单用普萘洛尔（E错）仅适用于高功能腺瘤的术前准备，可缩短术前准备时间，且术后能立即了解甲状腺残留部分的功能状态（七版黄家驷外科学P1131）。临床上无抗甲状腺药+普萘洛尔（D错）的术前准备方案。